男，20岁。3年前无明显诱因渐起孤僻少语，不愿参加集体活动，甚至与父母也很少交流，上课时注意力不集中，成绩下降。个人生活懒于料理。该患者最适宜做的检查是
A. 全面的精神检查
B. MRI检查
C. 脑电图
D. 超声检查
E. 血清学捡查

正确答案：A。全面的精神检查

解析：该青年患者，3年前（起病缓慢）无明显诱因渐起孤僻少语，不愿参加集体活动，甚至与父母也很少交流，上课时注意力不集中，成绩下降（缺乏进取心），个人生活懒于料理（生活懒散），主要以阴性症状为表现，故最可能的诊断为精神分裂症单纯型。最适宜的检查是全面的精神检查（A对）。目前尚无特异性的标示为精神分裂症的特征性症状，但出于实践的目的，诊断标准对某些症状或症状群界定为对作出诊断有特殊意义。